多见于老年人，牙髓中的胶原纤维玻璃样变，胶原纤维与牙髓长轴平行，是以下哪种疾病的病理表现
A. 牙髓坏死
B. 牙髓钙化
C. 牙髓网状萎缩
D. 牙髓纤维变性
E. 成牙本质细胞空泡变性

正确答案：D。牙髓纤维变性

解析：本题考查牙髓变性。多见于老年人，牙髓中的胶原纤维玻璃样变，胶原纤维与牙髓长轴平行，是牙髓纤维变性（D对）的病理表现。牙髓纤维性变：常因牙髓供血不足导致，牙髓细胞、血管、神经萎缩减少甚至消失，纤维成分增多。粗大的胶原纤维与牙髓长轴平行或呈现均质状红染的玻璃样变性，多见于老年人牙髓。